藏药理论中，功效为润、重、稳、温，能生胃火，并兼顺气的药味是
A. 甘味
B. 酸味
C. 咸味
D. 苦味
E. 辛味

正确答案：B。酸味

解析：本题考查酸味的功效。藏药理论中，功效为润、重、稳、温，能生胃火，并兼顺气的药味是酸味（B对）。①功效：甘味（A错）功效稀、凉、钝、软，能增长元气和体力，对老人小孩有补益作用，能医治隆病、赤巴病，对消瘦、气管炎、肺病有特效，如野牛肉、鱼肉、绵羊肉、蜂蜜等有补虚作用。但除了陈青稞、干燥地方产的肉以外，一般能诱发培根病。酸味功效润、重、稳、温，能生胃火，增强消化，能使油脂糜烂稀释，并兼顺气，能治培根病，其中余甘子还能治血病、赤巴病、热症。用量过多，则会产生血液病、赤巴病等。咸味（C错）功效润、重、温，能使身体坚实，有疏通作用，能治闭塞梗阻症，用于罨熨时则产生胃火，有保健作用，能治隆、培根病。除了黑盐、光明盐以外，服用过量，能引发赤巴病，也会诱发培根病、麻风、丹毒等许多疾病，引起头发脱落、体力减弱。苦味（D错）功效轻、糙、凉、锐、浮等。能开胃、驱虫、止渴、解毒，医治赤巴病、麻风、晕眩、瘟疫等疾病。用之过量，则会引起体力减弱，诱发隆病、培根病等，但大托叶云实、宽筋藤都能治培根病和隆病。辛味（E错）功效温、锐、腻、糙等，能医治隆及培根病、脂肪增多症，去腐生肌，愈合伤口，使皮肤滋润光泽。除了大蒜和荜茇外，服用过量能引发赤巴病、隆病，导致胃液淤积、便秘、腹胀、心脏病、消瘦等。涩味功效凉、重、润、浮等，能医治血病、赤巴病、疮疖、皮肤粗糙等。除了诃子、毛诃子外，一般对培根病和隆病有害，服用过量可引起脘腹胀满、心脏疾病、劳伤虚损等。